下列哪项对诊断消化性溃疡意义最大
A. 钡餐透视局部有压痛、激惹、变形
B. 钡餐透视有龛影
C. 胃液分析为高胃酸
D. 多年周期性腹痛
E. 上腹部压痛

正确答案：B。钡餐透视有龛影

解析：慢性病程、周期性发作的节律性上腹疼痛是诊断消化性溃疡的重要线索，确诊有赖于胃镜检查。X线钡餐检查发现龛影亦有确诊价值。掌握“消化性溃疡”知识点。